四妙勇安汤的组成药物是
A. 玄参、甘草、当归、金银花
B. 陈皮、地丁、川芎、连翘
C. 连翘、蒲公英、苦参、板蓝根
D. 野菊花、黄连、地丁、桑叶
E. 赤芍、苦参、甘草、大青叶

正确答案：A。玄参、甘草、当归、金银花

解析：本题考查四妙勇安汤的药物组成。四妙勇安汤为清热剂，由金银花、玄参、当归、甘草组成（A对）。陈皮、地丁、川芎、连翘没有在四妙勇安汤药物组成中出现（B错）。连翘、蒲公英、苦参、板蓝根没有在四妙勇安汤药物组成中出现（C错）。野菊花、黄连、地丁、桑叶没有在四妙勇安汤药物组成中出现（D错）。赤芍、苦参、甘草、大青叶没有在四妙勇安汤药物组成中出现（E错）。记忆：趣记，金银归干婶。金银归甘参。